黄疸伴胆囊增大不会见于
A. 胆总管结石
B. 急性肝炎
C. 胰头癌
D. 壶腹癌
E. 胆囊结石

正确答案：B。急性肝炎

解析：黄疸是由于血清中胆红素升高致使皮肤、黏膜、巩膜发黄的症状和体征。黄疸伴胆囊增大提示胆总管有狭窄或梗阻。胰头癌（C对）是起源于胰头部分的恶性肿瘤，由于肿瘤压迫胆总管，在胆总管梗阻后可出现黄疸和胆囊增大。胆总管结石（A对）堵塞胆总管后胆红素的吸收和胆汁的排泄出现障碍，因而会引起黄疸和胆囊增大。壶腹癌（D对）指生长在乏特壶腹、十二指肠乳头、胆总管下端、胰管开口处癌的总称，在瘤体引起胆总管梗阻后即可出现黄疸和胆囊增大。急性肝炎（B错，为本题正确答案）指多种致病因素侵害肝脏，肝脏功能受损，继而引起人体一系列不适，但多不引起胆总管病变，因而黄疸和胆囊增大少见。胆囊结石（E对）长期嵌顿或阻塞胆囊管和胆总管时可引起胆囊增大和黄疸。